鉴别硫酸奎宁依据的反应是
A. 芳香第一胺的反应
B. 丙二酰脲的反应
C. 绿奎宁反应
D. 托烷生物碱的反应
E. 与二氯靛酚钠的反应

正确答案：C。绿奎宁反应

解析：本题考查硫酸奎宁的鉴别。奎宁为6位含氧喹啉衍生物，可以发生绿奎宁反应（C对），该反应为硫酸奎宁的专属鉴别反应。